小儿化毒散的功能是
A. 解表清热，宣肺化痰
B. 清热解毒，活血消肿
C. 宣肺，化痰，止咳
D. 清热利咽，解毒止痛
E. 解表宣肺，止咳化痰

正确答案：B。清热解毒，活血消肿

解析：本题考查的是小儿化毒散的功能。小儿化毒散的功能是清热解毒，活血消肿（B对）。小儿化毒散：【功能】清热解毒，活血消肿。儿感清口服液：【功能】解表清热，宣肺化痰（A错）。鹭鸶咯丸：【功能】宣肺，化痰，止咳（C错）。小儿咽扁颗粒：【功能】清热利咽，解毒止痛（D错）。解肌宁嗽丸：【功能】解表宣肺，止咳化痰（E错）。